卫生部门对发生食物中毒的患者的调查应包括
A. 发病人数
B. 共同进食的食品
C. 临床表现及共同点
D. 用药情况及疗效
E. 以上都是

正确答案：E。以上都是